制定《医院感染管理规范（试行）》的目的是
A. 有效预防和控制医院感染，保障医疗安全，提高医疗质量
B. 有效预防和控制传染性非典型肺炎的发生和流行
C. 预防、控制和消除传染病的发生与流行，保障公众的身体健康和生命安全
D. 有效预防、及时控制和清除突发公共卫生事件，保障公众身体健康与生命安全
E. 有效预防和控制疾病，维护正常的社会秩序

正确答案：A。有效预防和控制医院感染，保障医疗安全，提高医疗质量

解析：制定《医院感染管理规范（试行）》的目的是有效预防和控制医院感染，保障医疗安全，提高医疗质量（A对E错）。有效预防和控制传染性非典型肺炎的发生和流行为《传染性非典型肺炎防治管理办法》的目的（B错）。预防、控制和消除传染病的发生与流行，保障公众的身体健康和生命安全为传染病防治的原则（C错）。有效预防、及时控制和清除突发公共卫生事件，保障公众身体健康与生命安全为《突发公共卫生事件应急条例》的目的（D错）。